某乡镇制鞋企业女工，近期发现鼻子经常出血，经检查，WBC和血小板数量均低于正常值下限，应采取的措施不包括
A. 现场流行病学调查
B. 现场劳动卫生调查
C. 进一步的临床检查
D. 进一步的实验室检查
E. 由常规医院进行疾病的诊断

正确答案：E。由常规医院进行疾病的诊断

解析：本题考查职业病的诊断原则。根据题意可得知该工人在制鞋这类有害物质较高的企业工作后发病，高度怀疑其可能是由于工作造成的职业病。为诊断职业病，应遵循以下诊断原则。（1）职业史：是职业病诊断的重要前提；（2）现场调查，是诊断职业病的重要依据。应对该名工人和工厂进行现场流行病学调查（A对）和现场劳动卫生调查（B对）；（3）症状与体征，应根据调查获得的资料和工人的症状，进行进一步的临床检查（C对）；（4）实验室检查（D对），该检查对于诊断职业病具有重大意义。当怀疑患有职业病时，不应去常规医院进行疾病的诊断（E错，为本题正确答案），应当主动到有诊断职业病资质的医院进行专业的诊断。